涂抹患处后形成薄膜的液体制剂是
A. 搽剂
B. 甘油剂
C. 露剂
D. 涂膜剂
E. 醑剂

正确答案：D。涂膜剂

解析：本题考查涂膜剂。涂膜剂（D对）用时涂布于患处，会形成薄膜。搽剂（A错）系指原料药物用乙醇、油或适宜的溶剂制成的溶液、乳状液或混悬液，供无破损皮肤揉擦用的液体制剂；甘油剂（B错）系指药物溶于甘油中制成的专供外用的溶液剂；露剂（C错）系指含挥发性成分的药材用水蒸气蒸馏法制成的芳香水剂；醑剂（E错）系指挥发性药物的浓乙醇溶液，可以内服和外用。